下列哪项不是流行病学实验设计的原则
A. 设立对照的原则
B. 随机化的原则
C. 重复测量的原则
D. 盲法原则

正确答案：C。重复测量的原则

解析：本题考查实验流行病学的原则。实验流行病学的基本原则包括：对照（A对）、盲法（D对）、随机化（B对）。重复测量（C错，为本题正确答案）不是实验流行病学的基本原则。